药物从给药部位向循环系统转运的过程是
A. 胃排空速率
B. 肝肠循环
C. 首过效应
D. 代谢
E. 吸收

正确答案：E。吸收

解析：本题考查药物的体内过程。吸收（E对）是药物由给药部位向循环系统转运的过程；胃排空速率（A错）为胃排空的快慢；肠肝循环（B错）是指经胆汁或部分经胆汁排入肠道的药物,在肠道中又重新被吸收,经门静脉又返回肝脏的现象；首过效应（C错）是指某些药物经胃肠道给药，在尚未吸收进入血循环之前，在肠黏膜和肝脏被代谢，而使进入血循环的原形药量减少的现象；代谢（D错）是生物体内所发生的用于维持生命的一系列有序的化学反应的总称。